以下关于储金球的说法哪项是错误的
A. 可补偿合金凝固收缩
B. 可避免铸件缩孔
C. 直径略大于铸件蜡型最厚处
D. 位置距蜡型1mm
E. 应在铸圈的温度中心区

正确答案：D。位置距蜡型1mm

解析：本题考查储金球。蜡型是要离开热力中心区的，因此储金球要距离蜡型1.5～2mm（D错，为本题的正确答案）。放置储金球的目的是为了补偿合金凝固收缩（A对），避免铸件缩孔（B对），直径应该等于或略大于铸件蜡型最厚处（C对），这样才能保证完全补偿铸件收缩，且储金球必须位于铸圈的温度中心区（E对）（即热力中心区），这样才能使储金球里的金属保持熔融状态。